固冲汤除有固冲摄血外，还具有的功用
A. 补肾涩精
B. 补气健脾
C. 补气生血
D. 温补脾肾
E. 温经止痛

正确答案：B。补气健脾

解析：固冲汤主治脾肾虚弱，冲脉不固证；功用为益气健脾（B对），固冲摄血。方中重用白术、黄芪补气健脾，使气旺摄血；整方寓涩于补，固涩止血以治其标，补肾健脾以治其本；寄行于收，收敛固涩以救滑脱之急，行血化瘀以防止血留瘀。